不作为薄膜包衣材料使用的是
A. 硬脂酸镁
B. 羟丙基纤维素
C. 羟丙基甲基纤维素
D. 聚乙烯吡咯烷酮
E. 乙基纤维素

正确答案：A。硬脂酸镁

解析：本题考查片剂的包衣。硬脂酸镁（A错，为本题正确答案）为片剂常用的润滑剂（广义）。薄膜包衣材料通常由包衣材料、增塑剂、释放速度调节剂、增光剂、固体物料、色料和溶剂等组成。包衣材料按衣层的作用分为三类∶1）普通型包衣材料∶主要用于改善吸潮和防止粉尘等的薄膜衣材料，如羟丙甲纤维素（C对）、甲基纤维素、羟乙纤维素、羟丙纤维素（B对）、聚乙烯吡咯烷酮（PVP）（D对）等。2）缓释型包衣材料∶常用中性的甲基丙烯酸酯共聚物（Eudragit RS，Eudragit RL）和乙基纤维素（E对）。3）肠溶型包衣材料∶肠溶聚合物有耐酸性，通常在十二指肠及以下部位很容易溶解，常用的有醋酸纤维素酞酸酯（CAP）、聚乙烯醇酞酸酯（PVAP）、丙烯酸树脂（Eudragit S100，L100）、羟丙甲纤维素酞酸酯（HPMCP）等。